色素痣可以分为
A. 交界痣、皮内痣和恶性黑色素瘤
B. 交界痣、皮内痣和毛痣
C. 毛痣、雀斑样色素痣
D. 交界痣、皮内痣和雀斑样色素痣
E. 交界痣、皮内痣和混合痣

正确答案：E。交界痣、皮内痣和混合痣

解析：根据组织病理学特点，色素痣可以分为交界痣、皮内痣和混合痣三种。恶性黑色素瘤多来自交界痣。一般认为，毛痣、雀斑样色素痣均为皮内痣或复合痣。这类痣极少恶变，如有恶变亦来自交界痣部分。掌握“色素痣”知识点。